尺神经损伤的典型体征是
A. Froment征阳性
B. 拇指对掌功能受限
C. 拇指感觉异常
D. 垂腕
E. Finkelstein试验阳性

正确答案：A。Froment征阳性

解析：尺神经在腕部损伤主要表现为环、小指“爪形手”畸形，夹纸试验阳性、Froment征（A对）及手部尺侧半和尺侧一个半手指感觉障碍，肘上损伤除以上表现外还可出现环、小指末节屈曲功能障碍。拇指对掌功能障碍（B错）、拇指感觉异常（C错）为正中神经损伤的表现。垂腕（D错）为桡神经损伤的典型畸形。Finkelstein试验阳性（P718）（E错）即指握拳尺偏腕关节时，桡骨茎突处出现疼痛，见于桡骨茎突狭窄性腱鞘炎。